不轻易采用的给药途径是
A. 外用给药
B. 口服给药
C. 皮下注射
D. 肌内注射
E. 静脉滴注

正确答案：C。皮下注射